有机磷酸酯类农药中毒的机理是
A. 促进胆碱能神经释放乙酰胆碱
B. 抑制胆碱能神经释放乙酰胆碱
C. 促进肾上腺素能神经释放去甲肾上腺素
D. 抑制单胺氧化酶
E. 抑制胆碱酯酶

正确答案：E。抑制胆碱酯酶